下列不能作为固体分散体载体材料的是
A. PEG
B. 微晶纤维素
C. 聚维酮
D. 甘露醇
E. 泊洛沙姆

正确答案：B。微晶纤维素